黄曲霉毒素主要污染的食品是
A. 玉米和花生
B. 大豆和可可豆
C. 小麦和玉米
D. 大米
E. 山楂汁和苹果汁

正确答案：A。玉米和花生

解析：本题考查黄曲霉毒素主要污染的食品。黄曲霉毒素主要污染粮油及其制品，其中以玉米、花生（A对BCDE错）和棉籽油最易受到污染，其次是稻谷、小麦、大麦、豆类等。